戒断综合征一般出现在断药后时间为
A. 1～2h
B. 3～5h
C. 6～8h
D. 12～24h
E. 24～48h

正确答案：C。6～8h